不会引起嗜酸性粒细胞计数升高的疾病是
A. 荨麻疹
B. 药物性皮疹
C. 支气管哮喘
D. 严重烧伤
E. 湿疹

正确答案：D。严重烧伤

解析：本题考查引起嗜酸性粒细胞计数升高的因素。不会引起嗜酸性粒细胞计数升高的疾病是严重烧伤（D错，为本题正确答案）。伤寒、副伤寒，大手术后、严重烧伤等应激状态表现为嗜酸性粒细胞减少。荨麻疹（A对）、药物性皮疹（B对）、支气管哮喘（C对）、湿疹（E对）表现为嗜酸性粒细胞增多。